以6年生秋季为适宜采收期的栽培药材是
A. 天花粉
B. 山药
C. 桔梗
D. 人参
E. 太子参

正确答案：D。人参

解析：本题考查的是中药材适宜采收期确定的一般原则。以6年生秋季为适宜采收期的栽培药材是人参（D对）。中药材适宜采收期确定的一般原则有：①双峰期，即有效成分含量高峰期与产量高峰期基本一致时，共同的高峰期即为适宜采收期。许多根及根茎类中药，在秋冬季节地上部分枯萎后和春初植物发芽前或刚露苗时，既是有效成分高峰期，又是产量高峰期，这个时期就是它们最适宜采收期。如莪术、郁金、姜黄、天花粉（A错）、山药（B错）等。②当有效成分的含量有一显著的高峰期，而药用部分的产量变化不大时，此含量高峰期，即为适宜采收期。如三颗针。③有效成分含量无显著变化，药材产量的高峰期应为最适宜采收期。如牡丹皮。④有效成分含量高峰期与产量不一致时，有效成分总含量最高时期即为适宜采收期。如人参，6年生者在秋季药材产量和人参皂苷总含量均较高，故栽培人参应以6年生者秋季为适宜采收期。⑤有些药材，除含有效成分外，尚含有毒成分，在确定适宜采收期时应以药效成分总含量最高、毒性成分含量最低时采集为宜。桔梗（C错）为春、秋二季采挖。太子参（E错）由于植株枯萎时间较早，则在夏季采收。